男，39岁。行甲状腺癌根治术后1天，感觉面部针刺样麻木，手足抽搐。正确的处理措施是
A. 静脉注射钙剂
B. 伤口切开
C. 口服维生素D₃
D. 气管切开
E. 口服葡萄糖酸钙

正确答案：A。静脉注射钙剂

解析：患者甲状腺癌根治手术后一天，感觉面部针刺样麻木，手足抽搐，考虑为甲状旁腺损伤导致的低钙血症。此时正确的处理措施是静脉注射钙剂（A对），可迅速提高血钙，降低神经及肌肉的应激性，缓解手足抽搐症状。伤口切开（B错）、气管切开（D错）为甲状腺术后伤口血肿压迫气管的急救措施。口服维生素D3（C错）、口服葡萄糖酸钙（E错）可提高血钙，但起效慢，不作首选。